下列辅料中，属于水不溶性包衣材料是
A. 聚乙烯醇
B. 醋酸纤维素
C. 羟丙基纤维素
D. 聚乙二醇
E. 聚维酮

正确答案：B。醋酸纤维素

解析：本题考查片剂的包衣。醋酸纤维素（B对）属于水不溶性包衣材料；聚乙烯醇（A错）为水溶性包衣材料；羟丙基纤维素（C错）为普通型包衣材料；聚乙二醇（D错）和聚维酮（E错）均为黏合剂。